口腔健康教育的方法一般是
A. 个别交谈、网络交流、大众传播渠道、组织社区活动
B. 个别交谈、小型讨论会、大众传播渠道、组织社区活动
C. 个别交谈、小型讨论会、学校授课、组织社区活动
D. 专家咨询、小型讨论会、大众传播渠道、组织社区活动
E. 专家咨询、网络交流、大众传播渠道、组织社区活动

正确答案：B。个别交谈、小型讨论会、大众传播渠道、组织社区活动

解析：本题考查口腔健康教育的方法。口腔健康教育的方法有大众传媒、社区活动、小型讨论会、个别交谈（B对）。大众传媒是通过网络、报刊、杂志、电视、电影、广播、街头展板于宣传橱窗等传播口腔健康信息；社区活动是城市街道、农村乡镇和社会团体与单位的有组织活动，使人们提高对口腔健康的认识，强化口腔健康服务资源的利用；小型讨论会包括社区座谈会、专家研讨会、专题讨论会、听取群众意见会等；个别交谈是指口腔专业人员就口腔健康问题与预防保健问题与就诊患者、单位领导、儿童家长、社区保健人员等进行交谈、讨论。网络交流（AE错）属于大众传媒的内容。学校授课（C错）属于小型讨论会的范畴。专家咨询（DE错）属于个别交谈的范畴。